以下是联合毒性作用的类型，哪项除外
A. 相乘作用
B. 拮抗作用
C. 相加作用
D. 协同作用
E. 增强作用

正确答案：A。相乘作用

解析：本题考查是联合毒性作用的类型。联合作用的类型有：1.相加作用（C对）：两种或两种以上化学物对机体产生的毒效应强度等于各化学物单独作用的毒效应之和；2.协同作用（D对）：两种或两种以上的化学物对机体所致的毒效应强度大于各化学物单独作用的毒效应之和；3.拮抗作用（B对）：两种或两种以上的化学物的毒效应强度小于各化学物单独作用的毒效应之和；4.增强作用（E对）：一种化学物对某器官或系统并无毒性，但与另 一种化学物同时或先后暴露时使其毒性效应增强；5.独立作用：两种或两种以上的化学物引起的生物学效应互不干扰，从而表现为各自的毒效应。相乘作用（A错，为本题正确答案）不是联合毒性作用的类型。